人体骨骼发育正常与否，主要取决于
A. 肝藏血，血能充养全身
B. 脾主运化水谷精微，以养周身
C. 肾藏精，精能生髓
D. 心主血脉，推动血液输送周身
E. 肺能形成宗气，贯心肺以行气血，奉养周身

正确答案：C。肾藏精，精能生髓

解析：该题考查肾的系统联系。肾在体合骨，荣齿，其华在发，肾经具有生髓而充养骨骼的功能（C对）。心在体合脉，其华在面（D错）；肺在体合皮，其华在毛（E错）；肝在体合筋，其华在爪（A错）；脾在体合肉，主四肢（B错）